牙槽窝颊侧骨板折断易出现在拔除
A. 上颌中切牙
B. 下颌中切牙
C. 上下颌尖牙
D. 上颌前磨牙
E. 下颌前磨牙

正确答案：C。上下颌尖牙

解析：本题考查易出现牙槽窝颊侧骨板折断的牙齿。上下颌尖牙唇侧骨板都较舌侧者为薄，上下颌牙尖牙（C对）牙根粗大且长，不易拔出，行拔除术时，易造成唇侧骨板折断。上颌中切牙（A错）牙根较直，且为近圆锥形单根，容易拔出，一般不会致使唇侧骨板折断。下颌中切牙（B错）牙冠小，牙根扁平而较短，且近远中径小，多为直根，容易拔出，不会导致唇侧骨板折断。上颌前磨牙（D错）是扁根，上颌第一前磨牙在根尖1/2或1/3处分为颊腭两个较细易断的根，第二前磨牙多为单根，尽管颊侧骨板较薄，但一般不会导致颊侧骨板折断。下颌前磨牙（E错）牙根均为锥形单根，易被拔除，拔出过程中不会损伤颊侧骨板，不会导致颊侧骨板的折断。